关于生物膜说法错误的是
A. 生物膜是细胞膜（质膜）、细胞器膜的总称
B. 生物膜在机体主要起隔离功能、进行生化反应和生命现象的场所、外环境物质交换屏障三个作用
C. 生物膜的转运方式主要有被动转运、易化扩散、主动转运
D. 易化扩散和主动转运由载体介导，可饱和。

正确答案：C。生物膜的转运方式主要有被动转运、易化扩散、主动转运

解析：本题考查生物膜的相关内容。生物膜是把细胞或细胞器与周围环境分隔开来的半透膜，包括细胞膜（质膜）和细胞器的膜（A对）。生物膜在机体主要起隔离功能、进行生化反应和生命现象的场所、外环境物质交换屏障三个作用（B对）。化学毒物通过生物膜的方式可分为被动转运、特殊转运和膜动转运三类（C错，为本题正确答案）。被动转运包括简单扩散和滤过, 特殊转运包括主动转运、易化扩散，而膜动转运主要包括胞吞作用和胞吐作用。易化扩散和主动转运由载体介导，可饱和（D对）。